女，33岁，主诉：近1～2年来自觉全口多数牙齿松动，咀嚼力量减弱。若诊断为快速进展型牙周炎，临床检查最有可能的发现是
A. 多数牙移位
B. 多发的牙周脓肿
C. 磨牙根分叉病变3度
D. 多数牙牙槽骨呈中重度吸收
E. 多数牙牙龈退缩明显

正确答案：D。多数牙牙槽骨呈中重度吸收

解析：本题考查侵袭性牙周炎。快速进展型牙周炎主要发生在青春期至35岁之间，病损呈弥漫性，累及大多数牙，有严重及快速的骨破坏，多数牙牙槽骨呈中重度吸收（D对）。多数牙移位（A错）主要表现在快速进展型牙周炎的晚期，根据病例描述患者发病2年左右，全口多数牙有松动，则可知牙槽骨有中重度吸收，患者觉咀嚼力减弱，可见并不是处于快速进展型牙周炎晚期，因此不太可能有多数牙的移位。多发的牙周脓肿（B错）和磨牙根分叉病变3度（C错）都是各型牙周炎晚期的伴发症状，患者的快速进展型牙周炎并不是处于晚期，故不太可能出现这种情况。多数牙牙龈退缩明显（E错）可见于牙周炎经治疗后炎症消退，牙周袋壁退缩，或牙周手术切除牙周袋使牙根暴露的情况，病例中未诉患者有牙周治疗史，故出现这种情况几率不大。